见光容易氧化分解的药物是
A. 乙醚
B. 液体石蜡
C. 冰醋酸
D. 95%乙醇
E. 稀盐酸

正确答案：A。乙醚